胎头衔接是指
A. 枕骨进入骨盆入口平面
B. 顶骨进入骨盆入口平面
C. 双顶径进入骨盆入口平面
D. 双顶径到达坐骨棘平面
E. 双顶径到达坐骨结节平面

正确答案：C。双顶径进入骨盆入口平面

解析：胎头衔接是指胎头双顶径进入骨盆入口平面（C对）。